病人具有依从性是指其
A. 能自觉遵守医院的各项管理规章制度
B. 能遵守治疗方案、服从医护人员和药师对其健康方面的指导
C. 能服从护师对其进行治疗和监护的指导
D. 能听从药师对其用药方法，不良反应和注意事项的指导
E. 能遵守医师对其确定的治疗方案并顺从其指导

正确答案：B。能遵守治疗方案、服从医护人员和药师对其健康方面的指导

解析：本题考查依从性的概念。当患者能遵守医师确定的治疗方案及服从医护人员和药物对其健康方面的指导（B对）时，就认为这一患者具有依从性，反之则为不依从性。依从性并不限于药物治疗，还包括对饮食，吸烟、运动及家庭生活等多方面的指导的顺从。